厂房内产生有毒气体作业地点的通风排毒主要采用
A. 全面抽出式机械通风
B. 全面送入式机械通风
C. 有组织的全面自然通风
D. 局部送入式机械通风
E. 局部抽出式机械通风

正确答案：E。局部抽出式机械通风